青少年甲亢患者，内科常规治疗药物为
A. 丙基硫氧嘧啶
B. 普萘洛尔
C. 甲状腺素
D. ¹³¹I
E. 碘化钾

正确答案：A。丙基硫氧嘧啶